几种动物静脉注射的注射量范围是
A. 小鼠0.2～0.5ml
B. 大鼠1.0～2.0ml
C. 豚鼠1.0～5.0ml
D. 家兔3.0～10ml
E. 以上都是

正确答案：E。以上都是